诊断急性胃炎应选用
A. 胃镜检查
B. 钡餐造影
C. 腹部CT
D. 腹部B超
E. 胃液分析

正确答案：A。胃镜检查

解析：诊断急性胃炎主要依据胃镜检查（A对），可见胃黏膜水肿、糜烂和出血。钡餐造影（B错）主要用于消化性溃疡和胃癌的辅助诊断。腹部CT（C错）常用于胰腺炎、占位性病变的辅助诊断。腹部B超（D错）常用于腹腔实质脏器病变的辅助诊断。胃液分析（E错）测定基础胃酸排泌量、最大胃酸排泌量等，可用于消化性溃疡、慢性胃炎的辅助检查。